对未接种卡介苗者，结核菌素试验阳性的解释，最准确的是
A. 曾感染结核分枝杆菌
B. 曾接触肺结核患者
C. 处于结核病的活动期
D. 体液免疫功能正常
E. 已获得对结核感染的免疫力

正确答案：A。曾感染结核分枝杆菌

解析：结核菌素试验阳性反应表明机体对结核杆菌有变态反应，接种过卡介苗者结核菌素试验呈现阳性，对未接种卡介苗者，结核菌素试验阳性是因为过去曾感染过结核分支杆菌（A对），它是抗原（结核菌或卡介苗）进入机体使机体的免疫T淋巴细胞致敏，并大量分化增殖，当已致敏的机体再次遭受到抗原入侵时，致敏淋巴细胞就会与之结合，引起变态反应性炎症。结核病的发病机制主要是T细胞参与的细胞免疫，而不是体液免疫，故结核菌素试验阳性并不能说明体液免疫正常（D错）。结核分支杆菌的传播途径主要为空气传播，单纯接触肺结核患者但未被传染者结核菌素试验仍为阴性（B错）。结核病的活动期（C错），若为重症结核病如粟粒性结核病和结核性脑膜炎，结核菌素试验仍可为阴性。感染结核杆菌后，并不是每个人都会获得免疫力，需要看人体的免疫系统功能是否正常，若人体的免疫系统功能异常，则结核菌素试验阳性，并不能说明获得对结核感染的免疫力（E错）。